女，13岁。月经初潮后1年，月经周期1～4个月，经量多伴血块，此次行经已8日，量仍多。主要的止血措施是
A. 大剂量雄激素
B. 大剂量雌激素
C. 小剂量孕激素
D. 抗纤溶及促凝药物
E. 诊断性刮宫术

正确答案：B。大剂量雌激素

解析：该患者为青春期女性，月经初潮后1年，月经周期1～4个月（周期不规则），经量多伴血块（经量增多），此次行经已8日（经期延长），量仍多（为急性大量出血），考虑青春期无排卵性功能失调性子宫出血。这是由于在青春期，下丘脑-垂体-卵巢轴激素间的反馈调节尚未成熟，导致雌激素水平低，子宫内膜修复能力差而引起出血。主要止血措施是应用大剂量雌激素（B对A错），其可迅速促使子宫内膜生长，短期内修复创面而止血。孕激素（P348）（C错）止血机制是使雌激素作用下的持续增生的子宫内膜转化为分泌期，达到止血效果，停药后子宫内膜脱落较完全，起到药物性刮宫作用，适用于体内已有一定雌激素水平的患者。抗纤溶及促凝药物（D错）适用于凝血功能异常的患者。刮宫术（P348）（E错）可迅速止血，适用于绝经过渡期及病程长的生育年龄患者，但对无性生活史青少年，不轻易做刮宫术。